胰岛α细胞分泌的是
A. 胰高血糖素
B. 胰岛素
C. 促胃液素
D. 胰多肽
E. 生长抑素

正确答案：A。胰高血糖素

解析：胰高血糖素（A对）由胰岛α（A）细胞分泌。胰岛素（B错）由胰岛B细胞分泌。促胃液素（C错）由胃窦、十二指肠G细胞分泌。胰多肽（D错）由胰岛PP细胞分泌。生长抑素（E错）由胰岛D细胞分泌。